下列有关高胆红素血症的叙述中，错误的是
A. 体内胆红素生成过多
B. 血浆胆红素含量增多
C. 肝细胞对胆红素的摄取下降
D. 肝细胞对胆红素的转化下降
E. 肝细胞对胆红素的排泄能力增强

正确答案：E。肝细胞对胆红素的排泄能力增强

解析：体内胆红素生成过多，或肝细胞对胆红素的摄取、转化及排泄能力下降等因素均可引起血浆胆红素含量增多，称为高胆红素血症。过量的胆红素可扩散进入组织造成组织黄染，这一体征称为黄疸。掌握“胆色素代谢”知识点。